能够去除玻璃器皿中热原的方法有
A. 高温法
B. 酸碱法
C. 超滤法
D. 吸附法
E. 反渗透法

正确答案：A、B。高温法；酸碱法

解析：本题考查去除热原的方法。除去容器或用具上热原的方法：①高温法（A对）：对于耐高温的容器或用具，如注射用针筒及其他玻璃器皿，在洗涤干燥后，经180℃加热2小时或250℃加热30分钟，可以破坏热原。②酸碱法（B对）：对于耐酸碱的玻璃容器、瓷器或塑料制品，用强酸强碱溶液处理，可有效地破坏热原，常用的酸碱液为重铬酸钾硫酸洗液、硝酸硫酸洗液或稀氢氧化钠溶液。超滤法（C错）、吸附法（D错）、反渗透法（E错）是除去药液或溶剂中热原的方法。